内含马钱子的中成药为
A. 风湿定片
B. 大活络丸
C. 疏风定痛丸
D. 牛黄千金散
E. 牛黄解毒丸

正确答案：C。疏风定痛丸

解析：本题考查的是医疗用毒性中药的内容。内含马钱子的中成药为疏风定痛丸（C对）。含马钱子的中成药：九分散、山药丸、舒筋丸、疏风定痛丸、伤科七味片等。大活络丸（B错）所含附子，属于乌头类药物。乌头类药物：（一）乌头类药物和含乌头类药物的中成药：1.中药材：川乌、草乌、附子、雪上一枝蒿等。2.中成药：追风丸、追风透骨丸、三七伤药片、附子理中丸、金匮肾气丸、木瓜丸、小金丸、风湿骨痛胶囊、祛风止痛片、祛风舒筋丸、正天丸、右归丸等。牛黄千金散（D对）含朱砂。含朱砂、轻粉、红粉的中成药：牛黄清心丸、牛黄抱龙丸、抱龙丸、朱砂安神丸、天王补心丸、安神补脑丸、苏合香丸、人参再造丸、安宫牛黄丸、牛黄千金散、牛黄镇惊丸、紫雪散、梅花点舌丸、紫金锭（散）、磁朱丸、更衣丸、复方芦荟胶囊。牛黄解毒丸（E错）含雄黄。含雄黄的中成药：牛黄解毒丸（片）、六神丸、喉症丸、安宫牛黄丸、牛黄清心丸、牛黄镇惊丸、牛黄抱龙丸、牛黄至宝丸、追风丸、牛黄醒消丸、紫金锭（散）、三品等。风湿定片（A错）的药物组成，2022年考试指南未明确说明。